《医疗机构制剂许可证》有效期届满，需要继续配制制剂的，提出申请换发新证的时间应在届满前
A. 15日前
B. 30日前
C. 60日前
D. 3个月
E. 6个月

正确答案：E。6个月

解析：本题考查医疗机构制剂许可证的管理。《医疗机构制剂许可证》有效期届满，需要继续配制制剂的，医疗机构应当在许可证有效期届满前6个月（E对），按照国家药品监督管理部门的规定申请换发。